正确的是
A. 平第1腰椎高度起自腹主动脉
B. 位于肾盂前方
C. 除分布至肾外无其他分支
D. 左侧比右侧长
E. 是腹主动脉的惟一成对脏支

正确答案：B。位于肾盂前方

解析：肾动脉约平第1 -2腰椎椎间盘的高度起于腹主动脉（A错），除分布至肾外在进入肾之前发出肾上腺下动脉（C错）。由于左肾更靠近腹主动脉，所以左侧肾动脉比右侧短（D错）。腹主动脉成对的脏支（E错）有肾上腺中动脉、肾动脉、睾丸动脉（男性）或卵巢动脉（女性）。在肾窦内，肾动脉位于肾盂前方（B对），肾静脉后方。